用某疗法治疗胃溃疡病人50例，一个月后40例好转，由此可认为
A. 该疗法疗效好
B. 该疗法疗效一般
C. 该疗法疗效只有近期疗效
D. 因治疗例数少，尚不能说明该疗法的疗效如何
E. 因无对照，尚不能说明该疗法的疗效如何

正确答案：E。因无对照，尚不能说明该疗法的疗效如何